国家基本药物目录的遴选原则之一是
A. 以非处方药为主
B. 临床必需、安全有效
C. 以中草药为主
D. 有利于节约药品资源
E. 有利于政府管理药品市场

正确答案：B。临床必需、安全有效

解析：本题考查基本药物目录遴选原则。国家基本药物目录的遴选原则之一是临床必需、安全有效（B对）。国家基本药物遴选应当按照防治必需、安全有效、价格合理、使用方便、中西药并重、基本保障、临床必需和基层能够配备的原则，结合我国用药特点，参照国际经验，合理确定品种（剂型）和数量。